降香的原植物属于
A. 唇形科
B. 豆科
C. 木兰科
D. 茜草科
E. 蔷薇科

正确答案：B。豆科

解析：本题考查的是降香的来源。降香的原植物属于豆科（B对）。降香：【来源】为豆科植物降香檀的树干和根的干燥心材。来源于唇形科（A错）的中药有丹参、黄芩、紫苏叶、广藿香、荆芥、益母草、薄荷、半枝莲、香薷等。来源于木兰科（C错）的中药有厚朴、辛夷、五味子、南五味子等。来源于茜草科（D错）的中药有巴戟天、茜草、钩藤、栀子、白花蛇舌草等。来源于蔷薇科（E错）的中药有地榆、枇杷叶、木瓜、山楂、苦杏仁、桃仁、乌梅、金樱子等。